为将每日代谢所产生的大约600mmol/L的溶质（废物）完全溶解排出，需要的尿量至少是
A. 400ml
B. 500ml
C. 600ml
D. 800ml
E. 1000ml

正确答案：B。500ml

解析：终尿的渗透浓度最高可高达1200mOsm/（Kg.H₂O）（等价于1200mmol/L），为了将体内600mmol/L的溶质排出，至少（600÷1200）L＝0.5L，所以需要500ml的尿量（B对）。